男，16岁。左胫腓骨闭合性骨折，管形石膏外固定，3小时后左小腿出现胀痛，并持续加重，足趾麻木，被动牵拉痛。对其首要的处理是
A. 给予止痛药物、继续观察
B. 立即拆除石膏
C. 给予脱水药、继续观察
D. 给予抗生素治疗
E. 不需处理、继续观察

正确答案：B。立即拆除石膏

解析：病人左胫腓骨闭合性骨折， 管形石膏外固定后左小腿胀痛，足趾麻木，被动牵拉痛，考虑石膏绷带包扎过紧导致的骨筋膜室综合征。故首要处理是立即拆除石膏减压（B对），否则继续发展可致肢体坏疽。拆除石膏后，应给予抗生素（D错）、脱水（C错）药物治疗，酌情应用止痛药物（A错），并继续观察病情（E错）。